患者，男，41岁，因甲状腺功能亢进症，服用甲巯咪唑治疗5个月，目前剂量是10mgqd，今日查血常规：白细胞1.50×10⁹/L（成人正常参考值为4×10⁹/L～10×10⁹/L），中性粒细胞0.5×10⁹/L（成人正常参考值为1.8×10⁹/L，6.3×10⁹/L）。根据血常规检查结果，关于该患者用药方案调整的说法，正确的是
A. 将甲巯咪唑减量至每日5mg
B. 甲巯咪唑减量至每日5mg，并加用粒细胞集落刺激因子
C. 停用甲巯咪唑，严密观察，必要时加用粒细胞集落刺激因子
D. 停用甲巯咪唑，改为丙硫氧嘧啶50mgtid
E. 停用抗甲状腺药，立即手术治疗

正确答案：C。停用甲巯咪唑，严密观察，必要时加用粒细胞集落刺激因子

解析：本题考查甲巯咪唑。抗甲状腺药物在白细胞计数偏低、肝功能异常等情况下慎用；对硫脲类过敏、中性粒细胞减少或缺乏时禁用。该患者的白细胞和中性粒细胞均低于正常值，当白细胞低于3×10⁹/L或中性粒细胞低于1.5×10⁹/L应立即停药。该患者符合停用甲巯咪唑指标，并且粒细胞减少，需要加用粒细胞集落刺激因子（C对）。患者白细胞及中性粒细胞均低于正常值，应停用抗甲状腺药物（AB错）。患者目前剂量为10mg qd处于维持量，说明患者甲亢症状有所缓解没有必要进行手术治疗（E错）。